颏舌肌的作用为
A. 单侧收缩时使舌尖伸向同侧
B. 单侧收缩时使舌尖伸向对侧
C. 双侧收缩时拉舌尖向后下方
D. 双侧收缩时使舌缩短
E. 上述皆不正确

正确答案：B。单侧收缩时使舌尖伸向对侧

解析：颏舌肌单侧收缩可使舌尖伸向对侧(A错B对)，双侧收缩拉舌向前下(CD错)。